可获得全身和局部的双重作用
A. 1.23%含氟凝胶
B. 氟滴剂
C. 牛奶氟化
D. 食盐氟化
E. 饮水氟化

正确答案：B。氟滴剂

解析：氟滴剂是一种含氟的溶液，每滴含氟离子0.125mg，适用于2岁以下的幼儿。每日睡前将氟滴剂滴于幼儿颊黏膜或舌部，不漱口、不饮水，可获得全身和局部的双重作用。选择应用的原则和每天补充的氟化物量与氟片相同。研究显示使用氟滴剂可使患龋率降低40%。掌握“氟的全身及局部应用”知识点。